既疏肝理气，又和中化痰的药是
A. 枳实
B. 佛手
C. 薤白
D. 青皮
E. 柿蒂

正确答案：B。佛手

解析：本题考查的是佛手的功效。既疏肝理气，又和中化痰的药是佛手（B对）。佛手：【功效】疏肝理气，和中，化痰。枳实（A错）：【功效】破气消积，化痰除痞。薤白（C错）：【功效】通阳散结，行气导滞。青皮（D错）：【功效】疏肝破气，消积化滞。柿蒂（E错）：【功效】降气止呃。